以CO给大鼠经呼吸道急性染毒后红细胞缺氧血红蛋白含量升高，此为
A. 效应
B. 反应
C. 剂量-效应关系
D. 剂量-反应关系
E. 有的个体不遵循剂量（效应）反应关系规律

正确答案：A。效应